男，30岁，间断右下腹痛一年。加重伴腹泻一月，大便每日4-5次，黄色稀便，无黏液脓血，伴低热，体重减轻4kg。既往反复发作肛瘘1年，曾手术治疗。查体：T37.5℃，右下腹轻压痛，肛门视诊可见肛瘘开口，粪隐血（+++），肠镜检查发现回肠末端、回盲瓣多发溃疡，病变间黏膜基本正常。结肠、直肠未见明显异常。黏膜活检病理检查最有助于诊断的发现是
A. 抗酸抗体阳性
B. 淋巴细胞浸润
C. 含铁血红素沉积
D. 隐窝脓肿
E. 非干酪样肉芽肿

正确答案：E。非干酪样肉芽肿

解析：患者间断右下腹痛、腹泻（黄色稀便，无黏液脓血）、体重减轻，伴低热、肛瘘，肠镜检查发现回肠末端、回盲瓣多发溃疡，病变间黏膜基本正常（P375）。可诊断为克罗恩病。黏膜活检病理检查最有助于诊断的发现是非干酪样肉芽肿（P375）（E对）。抗酸抗体阳性（A错）、干酪样肉芽肿可见于肠结核。隐窝脓肿（D错）见于UC。